与体内过氧化物和自由基结合，保护细胞中含巯基的蛋白质和酶，参与多种有毒物质解毒反应的药物是
A. 葡醛内酯
B. 还原型谷胱甘肽
C. 多烯磷脂酰胆碱
D. 甘草酸二铵
E. 熊去氧胆酸

正确答案：B。还原型谷胱甘肽

解析：本题考查还原型谷胱甘肽。与体内过氧化物和自由基结合，保护细胞中含巯基的蛋白质和酶，参与多种有毒物质解毒反应的药物是还原型谷胱甘肽（B对）；葡醛内酯（A错）有保护肝脏及解毒作用；多烯磷脂酰胆碱（C错）可用于以肝细胞膜损害为主的急慢性肝炎患者；甘草酸二铵（D错）可阻碍可的松与醛固酮的灭活，从而发挥类固醇样作用，但无皮质激素的不良反应；熊去氧胆酸（E错）是正常胆汁成分的异构体，可增加胆汁分泌，抑制肝脏胆固醇合成，减少肝脏脂肪，松弛Oddi括约肌，促进胆石溶解和胆汁排出。